癌组织中实质少，间质多是
A. 乳腺浸润性导管癌
B. 乳腺导管内癌
C. 乳腺单纯癌
D. 乳腺硬癌
E. 乳腺髓样癌

正确答案：D。乳腺硬癌

解析：乳腺硬癌（D对）的特点为肿瘤实质（癌细胞）少而纤维间质丰富，癌细胞排列为不规则条索状，散在于大量增生的纤维间质中。乳腺单纯癌（C错）的癌组织中实质与间质大致相等。乳腺浸润性导管癌（A错）的癌组织中实质与间质比例不同。乳腺导管内癌（B错）无间质浸润。乳腺髓样癌（E错）的癌组织中实质多而间质较少。